关于影响化学反应速度因素的叙述，正确的有
A. 一般来说，温度升高，制剂中药物的反应速度加快，稳定性下降
B. 一级降解反应的速度与制剂中药物浓度的一次方成正比
C. 液体制剂通常在某特定的pH条件下比较稳定
D. 光线能加速制剂中光敏性成分的氧化、水解、聚合
E. 一般而言，固体制剂较液体制剂要稳定

正确答案：A、B、C、D、E。一般来说，温度升高，制剂中药物的反应速度加快，稳定性下降；一级降解反应的速度与制剂中药物浓度的一次方成正比；液体制剂通常在某特定的pH条件下比较稳定；光线能加速制剂中光敏性成分的氧化、水解、聚合；一般而言，固体制剂较液体制剂要稳定